化学毒物经皮吸收必须具备下述哪项条件
A. 水溶性
B. 脂溶性
C. 水溶性和脂溶性
D. 分子量小于100

正确答案：C。水溶性和脂溶性

解析：本题考查化学毒物经皮吸收必须具备的条件。化学毒物经皮吸收必须具备水溶性和脂溶性（C对ABD错）条件。